酵（臭）米面食物中毒的病原物质为
A. 肠毒素
B. 杀白细胞素
C. 内毒素
D. 组胺类物质
E. 外毒素

正确答案：E。外毒素